隔蒜灸常用于治疗
A. 风寒痹痛
B. 疮疡久溃不敛
C. 中风脱证
D. 阳痿
E. 肿疡初起

正确答案：E。肿疡初起

解析：隔蒜灸可治疗初起的肿疡（E对）。隔姜灸常用于因寒而致的呕吐、腹痛以及风寒痹痛（A错）等，有温胃止呕、散寒止痛的作用。隔盐灸多用于治疗伤寒阴证或吐泻并作、中风脱证（C错）等，有回阳，救逆，固脱之力。隔附子饼灸 多用于治疗命门火衰而致的阳痿（D错）、早泄或疮疡久溃不敛（B错）等，有温补肾阳等作用。